女性，35岁，2月来发热，乏力伴消瘦，左颈、两侧腋窝和腹股沟部位可触及数个黄豆和蚕豆大小淋巴结，脾肋下3cm，血象正常，血沉80mm/h，胸部X线检查阴性，肝区B超正常，淋巴结活检为混合细胞型，淋巴瘤分期为
A. Ⅱ期A
B. Ⅱ期B
C. Ⅲ期A
D. Ⅲ期B
E. Ⅳ期A

正确答案：D。Ⅲ期B

解析：①Ⅰ期：病变仅限于一个淋巴结区（Ⅰ）或淋巴结外单一器官（IE）；②Ⅱ期：病变累及横膈同一侧两个或更多淋巴结区（Ⅱ）或病变局限侵犯淋巴结以外器官及横膈同侧一个以上淋巴结区（ⅡE）；③Ⅲ期：膈上下都已有淋巴结病变（Ⅲ）可以同时（Ⅲ）伴有脾累及（ⅢS）或淋巴结以外某一器官受累，加上膈两侧淋巴结受累（ⅢE）；④Ⅳ期：病变已侵犯多处淋巴结及淋巴结以外的部位，如累及肺、肝及骨髓等。各期按全身症状的有无分别为A、B两组。B组症状包括：①发热38℃以上，连续3天以上，且无感染原因；②6个月内体重减轻10%以上；③盗汗。掌握“淋巴瘤”知识点。